为研究肺癌的病因，将肺癌病例与非肺癌对照按年龄、性别、职业进行配比，然后对两组观察对象的吸烟情况进行调查，这是一种什么性质的研究
A. 描述性研究
B. 现况研究
C. 病例对照研究
D. 队列研究
E. 实验研究

正确答案：C。病例对照研究